女性垂体泌乳素瘤的典型临床表现是
A. 持续泌乳及头痛
B. 视野缺损和视力下降
C. 月经稀发
D. 体重增加并糖耐量减低
E. 闭经、泌乳

正确答案：E。闭经、泌乳

解析：女性垂体泌乳素瘤的典型临床表现是闭经泌乳（E对），闭经-溢乳综合征患者中2/3存在高催乳素血症，溢乳通常表现为双乳流出或可挤出非血性乳白色或透明液体。持续泌乳及头痛（A错）、视野缺损和视力下降（B错）、月经稀发（C错）、体重增加并糖耐量减低（D错）均不是垂体泌乳素瘤的典型临床表现。